+），红细胞少许，尿培养为大肠杆菌。应首先考虑的诊断是
A. 急性肾炎
B. 急性膀胱炎
C. 急性肾盂肾炎
D. 肾结核
E. 肾结石

正确答案：B。急性膀胱炎

解析：患者年轻女性，尿痛、尿频、尿急 （膀胱刺激症状）1天，脓尿（提示尿路感染）、血尿，尿培养为大肠杆菌（急性膀胱炎的常见致病菌），且肾区无叩击痛，患者应首先考虑的诊断是急性膀胱炎（B对）。急性肾盂肾炎（P498）（C错）患者表现为发热、寒战、头痛、全身酸痛、恶心、呕吐，且有肾区叩击痛。急性肾炎（P469）（A错）主要表现为血尿、蛋白尿、水肿、高血压。肾结核（人卫八版外科学P561）（D错）主要表现为尿频、尿急、尿痛、血尿、脓尿及贫血、低热、盗汗等结核杆菌中毒症状。肾结石（人卫八版外科学P576）（E错）主要表现为腰部绞痛、血尿、恶心、呕吐及膀胱刺激症状等。